男性，20岁。与人口角后，被人用利器扎伤颧颞部，造成软组织出血，急诊采用压迫止血，应该压迫的动脉是
A. 颌外动脉
B. 颞浅动脉
C. 上颌动脉
D. 耳后动脉
E. 颞深动脉

正确答案：B。颞浅动脉

解析：本题考查口腔颌面部创伤急救。指压止血：用手指压迫出血部位供应动脉的近心端，适用于出血较多的紧急情况，作为暂时止血，然后再改用其他方法作进一步止血。如在咬肌止端前缘的下颌骨面上压迫面动脉；在耳屏前压迫颞浅动脉（B对）等。